出自《希波克拉底誓言》的是
A. “上以疗君亲之疾，下以救贫贱之厄”
B. “若有疾厄来求救者，不得问其贵贱贫富、长幼妍媸、怨亲善友、华夷愚智，普同一等，皆如至亲之想：……”
C. “病人对某些科学研究拒绝参加时，绝对不能使医生和病人之间的关系受到影响或妨碍”
D. “我决心竭尽全力除人类之病痛，助健康之完美，维护医术的圣洁和荣誉”
E. “凡我所耳闻目睹的关于人们的私生活，我决不到处宣扬，我决不泄露作为应该守密的一切细节”

正确答案：E。“凡我所耳闻目睹的关于人们的私生活，我决不到处宣扬，我决不泄露作为应该守密的一切细节”

解析：“凡我所耳闻目睹的关于人们的私生活，我决不到处宣扬，我决不泄露作为应该守密的一切细节”（E对）出自《希波克拉底誓言》。“上以疗君亲之疾，下以救贫贱之厄”（A错）出自东汉名医张仲景的《伤寒杂病论》（P21）。“若有疾厄来求救者，不得问其贵贱贫富长幼妍媸怨亲善友华夷愚智，普同一等，皆如至亲之想”（B错）出自中国唐朝孙思邈所著之《备急千金要方》第一卷论《大医精诚》。“病人对某些科学研究拒绝参加时，绝对不能使医生和病人之间的关系受到影响或妨碍”（C错）出自《赫尔辛基宣言》。“我决心竭尽全力除人类之病痛，助健康之完美，维护医术的圣洁和荣誉”（D错）出自《中国医学生誓词》（P58）。